急性梗阻性化脓性胆管炎的主要致病菌是
A. 金黄色葡萄球菌
B. 大肠杆菌
C. 结核杆菌
D. 白色葡萄球菌
E. 溶血性链球菌

正确答案：B。大肠杆菌

解析：急性梗阻性化脓性胆管炎的主要致病菌是革兰阴性细菌，其中以大肠埃希菌（大肠杆菌）（B对）、克雷白菌最常见。